男，30岁。粘液脓血便伴里急后重2年。近1周腹痛加重，高热。体检：体温39.2℃，心率110次/分，贫血貌，腹部膨隆，全腹有压痛，肠鸣音消失。该病人最可能的诊断是
A. 肠结核并发肠穿孔
B. 溃疡性结肠炎并发中毒性巨结肠
C. 结肠癌并发肠梗阻
D. 肠易激综合征
E. 克罗恩病

正确答案：B。溃疡性结肠炎并发中毒性巨结肠

解析：中青年男性患者，黏液脓血便伴里急后重（溃疡性结肠炎的表现）2年。近1周腹痛加重，高热（病情急剧恶化）。体检：体温39.2℃（高热），心率110次/分（正常为60～100次/分），贫血貌，腹部膨隆（肠壁充血、肠腔膨大），全腹有压痛，肠鸣音消失（符合溃疡性结肠炎的临床表现）。综合患者病史与体检，考虑诊断为溃疡性结肠炎并发中毒性巨结肠（B对）。肠结核（P368）（A错）患者多有结核毒血症状，粪便呈糊样，多无脓血，不伴里急后重，很少并发肠穿孔。结肠癌（P382）（C错）好发于40～60岁。可有脓血便伴里急后重，并发肠梗阻时出现呕吐、肛门停止排便排气等表现。肠易激综合征（P386）（D错）患者粪便呈糊状或稀水样，少数可有黏液，但无脓血。克罗恩病（P377）（E错）临床以腹痛、腹泻、体重下降、腹块、瘘管形成和肠梗阻为特点，患者粪便多呈糊状，一般无黏液和脓血。